心脏压塞时不出现
A. 心音低钝
B. 声嘶
C. 奇脉
D. 肝颈静脉反流征阳性
E. 双肺满布干湿性啰音

正确答案：E。双肺满布干湿性啰音

解析：心脏压塞时可致肺淤血而出现呼吸困难，不出现双肺满布干湿性啰音（E错，为本题正确答案），可出现心音低钝（A对）、奇脉（C对）。心脏压塞可因压迫气管而产生声嘶（B对）。严重心脏压塞时，影响静脉回流，出现体循环淤血表现，如颈静脉怒张、肝大、肝颈静脉反流征阳性（D对）等。